导致动脉炎症性脑血栓的常见病原体是
A. 梅毒螺旋体
B. 隐球菌
C. 回归热螺旋体
D. 伯氏疏螺旋体
E. 曲霉菌

正确答案：A。梅毒螺旋体

解析：梅毒螺旋体感染后期，可引起闭塞性脑动脉炎（A对）。隐球菌（B错）可累及脑膜、肺、皮肤、骨骼系统和血液系统等器官和部位，其中脑膜炎最常见，其临床特点为剧烈头痛、脑膜刺激征阳性、脑脊液压力明显升高。回归热螺旋体（C错）感染病变主要见于脾、肾、肝、心、脑、骨髓等，临床特点为阵发性高热伴全身疼痛、肝脾大、发热期与间歇期交替反复出现的回归热。伯氏螺旋体（D错）引起莱姆病，临床表现为皮肤、神经、关节和心脏等多脏器、多系统受损，其中神经系统病变主要为进行性脑脊髓膜炎。曲霉菌（E错）最常侵犯支气管，表现为发热、胸痛、气短、咳嗽，可累及中枢神经系统多表现为脑脓肿。